人类结核病的主要致病病原体是
A. 牛型分枝杆菌
B. 非洲型分枝杆菌
C. 结核分枝杆菌
D. 田鼠分枝杆菌
E. 鸟型分枝杆菌

正确答案：C。结核分枝杆菌